突变发生在体细胞，结局主要是
A. 发生肿瘤
B. 抵抗力下降
C. 常见病增多
D. 遗传性疾病

正确答案：A。发生肿瘤

解析：本题考查体细胞突变的结局。突变发生在体细胞，结局主要是发生肿瘤（A对BCD错）。大多数环境化学物的致癌都是通过影响遗传物质起作用的，肿瘤是细胞中多种基因突变累积的结果。